在义齿修复前口腔软组织的处理措施中，不应包括
A. 黏膜病的治疗
B. 黏膜瘢痕组织的修整
C. 松软牙槽嵴的修整
D. 咀嚼肌功能训练
E. 唇、舌系带的修整

正确答案：D。咀嚼肌功能训练

解析：本题考查修复前口腔软组织的处理。咀嚼肌功能训练（D错，为本题正确答案）在义齿修复前口腔软组织的处理措施中不应包括的。修复前口腔软组织的处理包括：1.唇、舌系带的修整（E对），唇舌系带接近牙槽嵴顶或舌系带过短，影响义齿的固位和功能活动时应进行系带矫正术；2.黏膜瘢痕组织的修整（B对）和松软牙槽嵴的修整（C对），口腔内瘢痕组织对义齿的稳定和固位有影响时，可考虑切除修整，另有些患者由于戴用不良修复体时间过久，导致骨质大量吸收，牙槽嵴表面为一层松软可移动的软组织所覆盖，这些软组织不但不能有效地支持义齿，有时还会因受压产生炎症及疼痛，可在修复前予以切除修整；3.黏膜病的治疗（A对），黏膜也属于口腔软组织，其上的溃疡、炎症等在系统修复治疗前应当给予治疗，如有因配戴义齿导致义齿性口炎的患者，应该给予系统的治疗，并分析致病因素，对因施治，避免复发。